症见刺痛拒按，胁下肿块，出血，舌紫，脉涩者，证属
A. 气滞证
B. 气滞血瘀证
C. 血瘀证
D. 气虚血瘀证
E. 气不摄血证

正确答案：C。血瘀证

解析：本题考查的是血瘀证的临床表现及辨证要点。症见刺痛拒按，胁下肿块，出血，舌紫，脉涩者，证属血瘀证（C对）。血瘀证的临床表现，常见局部肿胀疼痛，痛如针刺，拒按，痛处固定不移，且常在夜间加重，一般伴有面色晦暗、口唇色紫、舌有瘀斑、口干但欲漱水不欲咽等症状。气滞证（A错）的临床表现，常见胀闷疼痛，妇女乳房胀痛。气滞血瘀证（B错）的临床表现，常见胸胁胀满走窜疼痛，性情急躁，并兼见痞块刺痛拒按，舌紫暗或有瘀斑等。妇女还可见月经闭止，或痛经、经色紫暗有块，乳房胀痛等症状。气不摄血证（E错）的临床表现，常见出血的同时，见有气短，倦怠乏力，面色苍白，脉软弱细微、舌淡等气虚的症状。气虚血瘀证（D错）的临床表现，2022年考试指南未明确说明。